男，45岁。进食高脂餐并饮酒后上腹持续疼痛8小时，呕吐2次后疼痛无缓解。查体：T37.8℃，上腹偏左压痛、反跳痛阳性。如需使用抗生素治疗，抗生素选择的最佳配伍是甲硝唑和
A. 阿奇霉素
B. 克林霉素
C. 环丙沙星
D. 亚胺培南
E. 青霉素

正确答案：C。环丙沙星

解析：中年男性患者，进食高脂餐并饮酒后上腹持续疼痛8小时、呕吐2次后疼痛无缓解（饮酒、进食高脂餐是急性胰腺炎的常见诱因，急性腹痛、吐后疼痛不缓解为急性胰腺炎的典型症状）。查体：T37.8℃，上腹偏左压痛、反跳痛阳性（腹膜刺激征为急性胰腺炎的常见体征）。综合患者的病史、查体，可初步诊断为急性胰腺炎。胰腺感染后，应选择针对革兰阴性菌和厌氧菌并能透过血胰屏障的抗生素，常用的有氟喹诺酮类抗生素如环丙沙星（C对）、氧氟沙星等或第三代头孢类药物如头孢噻肟、头孢曲松、头孢他啶等，联合抗厌氧菌的甲硝唑治疗。亚胺培南（D错）为广谱、强效抗菌药，可用于多种病原体所致和需氧/厌氧菌引起的混合感染；在治疗急性胰腺炎时，通常在引起严重感染或上述抗菌药无效时使用。阿奇霉素（A错）为第二代大环内酯类药物，主要用于治疗呼吸道及生殖道感染。青霉素（E错）属于β-内酰胺类抗生素，主要针对革兰阳性菌感染的治疗。克林霉素（B错）为林可霉素的衍生物，主要针对革兰阳性菌和厌氧菌感染的治疗。